产生IL-2的细胞是
A. Mφ
B. T细胞
C. B
D. NK
E. 中性粒细胞

正确答案：B。T细胞

解析：T细胞产生的IL-2可刺激其自身的生长，表现自分泌作用；树突细胞产生的IL-12刺激邻近的T细胞分化，表现旁分泌作用。掌握“细胞因子及受体”知识点。